磺胺类抗菌药物的主要排泄途径是
A. 乳汁排泄
B. 唾液排泄
C. 汗液排泄
D. 胆汁排泄
E. 尿液排泄

正确答案：E。尿液排泄

解析：本题考查药物排泄途径。磺胺类药主要通过尿液排泄（E对）。